慢性右心衰竭主要表现为
A. 心输出量绝对减少
B. 心输出量相对减少
C. 肺循环淤血
D. 体循环静脉淤血
E. 肺循环淤血伴有心输出量减少

正确答案：D。体循环静脉淤血

解析：慢性右心衰竭时，右心室泵血功能减退，导致右心输出量不足。心输出量不足导致心室收缩后滞留于内的血液增多，心室舒张期充盈压升高，体循环血液回流受阻，造成体循环静脉淤血（D对）。同理可知左心衰竭导致心输出量减少，进而引起心室充盈压升高，肺循环血液回流受阻，造成肺循环淤血（E错）。